患儿，男，12岁，踢足球摔伤左膝盖，左膝盖疼痛，浮髌实验（+），抽屉实验（-），Lachman实验（+），McMurray实验（-），该患者损伤的韧带为
A. 内侧副韧带损伤
B. 外侧副韧带损伤
C. 髌骨骨折
D. 交叉韧带损伤
E. 半月板损伤

正确答案：D。交叉韧带损伤

解析：该患儿，男，12岁，踢足球摔伤左膝盖（有外伤史），左膝盖疼痛（交叉韧带损伤的表现），浮髌实验（+），抽屉实验（-），Lachman实验（+），McMurray实验（-），提示为交叉韧带损伤（D对）。